足月男婴，出生后6小时即出现身黄，目黄，哭闹不安，呕吐，尿黄，舌质红，苔黄，指纹紫滞。治疗首选方剂是
A. 茵陈理中汤加减
B. 茵陈蒿汤加减
C. 黄连解毒汤加减
D. 羚角钩藤汤加减
E. 膈下逐瘀汤加减

正确答案：B。茵陈蒿汤加减

解析：患儿出生后6小时即出现身黄目黄尿黄，可判断为黄疸。本证起病急，为阳黄证。湿热蕴结脾胃，肝胆疏泄失常，胆汁外溢，则面目皮肤发黄；热扰心神则哭闹不止；邪困脾胃，升降失常，故呕吐；湿热蕴结，津液不布，则舌红苔黄腻，指纹紫滞均为湿热之象，故患儿为阳黄之湿热熏蒸证，治法为清热利湿退黄，方药可茵陈蒿汤加味（B对）。茵陈理中汤为黄疸阴黄之寒湿阻滞证的代表方剂，寒湿阻滞证的辨证要点为面目皮肤色黄，色泽晦暗，精神萎靡，四肢欠温，纳呆便溏，舌淡苔白腻（A错）。黄连解毒汤为肺炎之毒热闭肺、中毒型细菌性痢疾之毒邪内闭证的代表方剂（C错）。羚角钩藤汤为黄疸变证胎黄动风的代表方剂，胎黄动风以黄疽迅速加深，伴神昏、抽搐为特征（D错）。膈下逐淤汤主治积聚痞块，痛不移处，卧则腹坠，及由瘀血所致的肾泻、久泻（E错）。